男，70岁。咳嗽、咳痰30年，劳力性呼吸困难2年。加重伴双下肢水肿、尿少3天入院。胸部X线片检查最可能出现的心脏特点是
A. 靴形心
B. 梨形心
C. 烧瓶心
D. 心尖上翘
E. 普大形心

正确答案：D。心尖上翘

解析：患者老年男性，长期咳嗽、咳痰病史，劳力性呼吸困难2年，应考虑伴有COPD（慢性阻塞性肺疾病）；现症状加重伴双下肢水肿、尿少而入院，提示出现右心衰竭症状，故患者考虑诊断为慢性肺源性心脏病，并且已发展到肺、心功能代偿期。慢性肺心病患者X线胸部正位片可见右下肺动脉干增宽，肺动脉段凸出，心尖上翘（D对）。靴形心（A错）是指左心室增大，心浊音界向左下增大，心腰加深，状如靴形，临床常见于主动脉瓣关闭不全。梨形心（B错）表现为肺动脉段凸出及心尖上翘，主动脉结节缩小或正常，状如梨形，常见于二尖瓣狭窄引起的左心房增大合并明显肺动脉高压。虽然也可出现于慢性肺源性心脏病患者，但临床并不常见。烧瓶心（C错）指在X线胸片上，心影呈烧瓶样球形扩张，双侧心室增大圆隆，下大上小，类似烧瓶，为心包积液的特征性表现。普大型心（E错）是指左、右心室增大时，心界向两侧扩大，且左界向左下增大，多见于扩张型心肌病。